患者月经每提前8～9天来潮，量多，色深红，质黏稠，伴心烦，面红口干，小便短黄，大便燥结，舌红，苔黄，脉数。其治法是
A. 清热凉血调经
B. 清热凉血止血
C. 养阴清热调经
D. 清肝解郁凉血
E. 清热凉血固冲

正确答案：A。清热凉血调经

解析：患者月经每提前8～9天来潮考虑月经先期；量多，色深红，质黏稠，伴心烦，面红口干，小便短黄，大便燥结，舌红，苔黄，脉数考虑为月经先期的阳盛血热证，治法清热凉血调经（A对）。患者在月经期且无崩漏现象 无需止血（B错）。患者为实热证，不属阴虚（C错）。患者无肝郁的表现（D错）。患者无崩漏症状，无需固冲（E错）。